关于已糖激酶叙述正确的是
A. 己糖激酶又称为葡萄糖激酶
B. 它催化的反应基本上是可逆的
C. 使葡萄糖活化以便参加反应
D. 催化反应生成6-磷酸果酸
E. 是酵解途径的唯一的关键酶

正确答案：C。使葡萄糖活化以便参加反应